氟牙症与浅龋在病史方面比较明显的区别是
A. 病损对称性分布
B. 病损的好发部位
C. 病损的遗传特征
D. 有高氟地区生活史
E. 病损部位的软硬

正确答案：D。有高氟地区生活史

解析：关于病史方面，氟牙症有明显的生长发育期在高氟地区的生活史，而浅龋则没有此方面的病史。掌握“龋病的诊断及鉴别诊断”知识点。